根据《中华人民共和国药品管理法实施条例》，《药品经营许可证》有效期届满，需要继续经营药品的，持证企业申请换发新证的时间应在届满前
A. 7日
B. 15日
C. 30日
D. 3个月
E. 6个月

正确答案：E。6个月

解析：本题考查药品经营许可证管理。根据《中华人民共和国药品管理法实施条例》，《药品经营许可证》有效期届满，需要继续经营药品的，持证企业申请换发新证的时间应在届满前6个月（E对）。《中华人民共和国药品管理法实施条例》第三章药品经营企业管理第十六条：药品经营企业变更《药品经营许可证》许可事项的，应当在许可事项发生变更30日（C错）前，向原发证机关申请《药品经营许可证》变更登记；未经批准，不得变更许可事项。原发证机关应当自收到企业申请之日起15个工作日（B错）内作出决定。第十七条：《药品经营许可证》有效期为5年。有效期届满，需要继续经营药品的，持证企业应当在许可证有效期届满前6个月，按照国务院药品监督管理部门的规定申请换发《药品经营许可证》。药品经营企业终止经营药品或者关闭的，《药品经营许可证》由原发证机关缴销。